某妇女，核心行为表现是情绪好压抑，性格好自我克制，表面上处处依顺、谦和善忍，回避矛盾，内心却是强压怒火，爱生闷气。该妇女比别的妇女更容易得
A. 宫颈癌
B. 胃溃疡
C. 冠心病
D. 糖尿病
E. 不孕症

正确答案：A。宫颈癌